呈肾形，略扁，表面黑色、黑褐色或灰褐色，具细微网状皱纹，果皮薄，与种子不易分离气香，味辛、微苦的药材是
A. 沙苑子
B. 吴茱萸
C. 补骨脂
D. 牛蒡子
E. 牵牛子

正确答案：C。补骨脂

解析：本题考查的是补骨脂药材的性状鉴别。呈肾形，略扁，表面黑色、黑褐色或灰褐色，具细微网状皱纹，果皮薄，与种子不易分离气香，味辛、微苦的药材是补骨脂（C对）。补骨脂：【性状鉴别】药材呈肾形，略扁。表面黑色、黑褐色或灰褐色，具细微网状皱纹。顶端圆钝，有一小突起，凹侧有果梗痕。质硬。果皮薄，与种子不易分离；种子1枚，子叶2，黄白色，有油性。气香，味辛、微苦。沙苑子（A错）：【性状鉴别】药材略呈圆肾形而稍扁。表面绿褐色至灰褐色，光滑，边缘一侧微凹处具圆形种脐。质坚硬，不易破碎。除去种皮，有淡黄色子叶2片，胚根弯曲。气微，味淡，嚼之有豆腥味。吴茱萸（B错）：【性状鉴别】药材呈球形或略呈五角状扁球形。表面暗黄绿色至褐色，粗糙，有多数点状突起或凹下的油点。顶端有五角星状的裂隙，基部残留被有黄色茸毛的果梗。质硬而脆，横切面可见子房5室，每室有淡黄色种子1粒。气芳香浓郁，味辛辣而苦。牛蒡子（D错）：【性状鉴别】药材呈长倒卵形，略扁，微弯曲。表面灰褐色，带紫黑色斑点，有数条纵棱，通常中间1～2条较明显。顶端钝圆，稍宽，顶面有圆环，中间具点状花柱残迹；基部略窄，着生面色较淡。果皮较硬，子叶2，淡黄白色，富油性。气微，味苦后微辛而稍麻舌。牵牛子（E错）：【性状鉴别】药材似橘瓣状。表面灰黑色或淡黄白色，背面有1条浅纵沟，腹面棱线的下端有一点状种脐，微凹。质硬，横切面可见淡黄色或黄绿色皱缩折叠的子叶，微显油性。气微，味辛、苦，有麻感。加水浸泡后种皮呈龟裂状，手捻有明显的黏滑感。